男孩，2岁。1岁时患麻疹后食欲差，常有腹泻，身高83cm，体重7600g，面色苍白，皮肤干燥，腹部皮下脂肪0.3cm，心音低钝，脉搏缓慢。其主要诊断应是
A. 营养性贫血
B. 婴幼儿腹泻
C. 先天性甲状腺功能减低症
D. 蛋白质-热能营养不良
E. 心功能不全

正确答案：D。蛋白质-热能营养不良

解析：该患儿麻疹后食欲差并发生了腹泻，导致消化吸收不良，因此发生了蛋白质-能量营养不良症状，体重7600g（正常值为12kg）下降，面色苍白，皮肤干燥，腹部皮下脂肪0.3cm，心音低钝，脉搏缓慢。营养不良的早期表现是活动较少、精神较差、体重生长速度不增，皮下脂肪层厚度是判断营养不良程度的重要指标之一（D对）。